在药品的标签或说明书上，哪些文字和标志是不必要的
A. 注册商标图案
B. “注册商标”字样
C. 生产批准文号
D. 广告审查批准文号
E. 生产日期

正确答案：D。广告审查批准文号

解析：本题考查药品的标签或说明书的内容。在药品的标签或说明书上，广告审查批准文号（D错，为本题正确答案）是不必要的。《药品管理法》第四十九条规定，标签或者说明书应当注明药品的通用名称、成分、规格、上市许可持有人及其地址、生产企业及其地址、批准文号（C对）、产品批号、生产日期、有效期、适应症或者功能主治、用法、用量、禁忌、不良反应和注意事项。标签、说明书中的文字应当清晰，生产日期（E对）、有效期等事项应当显著标注，容易辨识。药品标签使用注册商标（A对）的，应当印刷在药品标签的边角，含文字的（B对），其文字以单字面积计不得大于通用名称所用字体的四分之一。